缺乏下列哪种营养素可引起多发性神经炎
A. 碳水化合物
B. 脂肪
C. 蛋白质
D. 钙
E. 维生素B₁

正确答案：E。维生素B₁